逍遥散合二陈汤适用于甲状腺功能亢进症的哪种证型
A. 心肝阴虚
B. 气滞痰凝
C. 心脾两虚
D. 肝火亢盛
E. 痰热瘀阻

正确答案：B。气滞痰凝

解析：逍遥散具有疏肝理气之功，二陈汤具有燥湿化痰之效，二者相合加减，可疏肝理气、化痰散结，用于甲状腺功能亢进症气滞痰凝证（B对）。心肝阴虚证（A错）治法为滋阴降火，消瘿散结，方药用天王补心丹加减；心脾两虚证（C错）治法为补益气血，健脾养心，方药为归脾汤加减；肝火亢盛证（D错），治法为清肝泻火，用龙胆泻肝汤加减；痰热瘀阻证（E错）治法为清热化痰，活血祛瘀。